某男，45岁。自诉咳喘数年，每至夏天，咳喘频发。刻下咳嗽、痰黄黏稠、口干咽痛、大便干燥，舌红、苔黄，脉弦滑数。证属痰热阻肺，宜选用的成药是
A. 二陈丸
B. 止嗽定喘口服液
C. 清肺抑火丸
D. 礞石滚痰丸
E. 半夏天麻丸

正确答案：C。清肺抑火丸

解析：本题考查的是清肺抑火丸的主治。自诉咳喘数年，每至夏天，咳喘频发。刻下咳嗽、痰黄黏稠、口干咽痛、大便干燥，舌红、苔黄，脉弦滑数。证属痰热阻肺，宜选用的成药是清肺抑火丸（C对）。清肺抑火丸：【主治】痰热阻肺所致的咳嗽、痰黄黏稠、口干咽痛、大便干燥。二陈丸（A错）：【主治】痰湿停滞导致的咳嗽痰多、胸脘胀闷、恶心呕吐。止嗽定喘口服液（B错）：【主治】表寒里热，身热口渴，咳嗽痰盛，喘促气逆，胸膈满闷；急性支气管炎见上述证候者。礞石滚痰丸（D错）：【主治】痰火扰心所致的癫狂惊悸，或喘咳痰稠、大便秘结。半夏天麻丸（E错）：【主治】脾虚湿盛、痰浊内阻所致的眩晕、头痛、如蒙如裹、胸脘满闷。